阿卡波糖片的适宜服药时间是
A. 清晨
B. 餐前
C. 餐中
D. 餐后
E. 睡前

正确答案：C。餐中

解析：本题考查药品服用的适宜时间。阿卡波糖片的适宜服药时间是餐中（C对）。阿卡波糖为α-葡萄糖苷酶抑制剂，餐中服用可减少对胃肠道的刺激和不良反应。适宜清晨（A错）服用的药物有抗高血压药物、利尿药、驱虫药、泻药等。适宜餐前（B错）服用的药物有胃黏膜保护剂、收敛药、促胃动力药等。适宜餐后（D错）服用的药物有非甾体抗炎药、维生素、组胺H₂受体阻断剂等。适宜睡前（E错）服用的药物有催眠药、平喘药、调节血脂药、缓泻药等。